以上哪种疾病的主要病理变化是骨的变性和坏死，可继发细菌感染
A. 放射性骨髓炎
B. 结核性骨髓炎
C. 慢性局灶性硬化性骨髓炎
D. 肉芽肿性唇炎
E. 急性化脓性骨髓炎

正确答案：A。放射性骨髓炎

解析：放射性骨髓炎病理变化主要是骨的变性和坏死，可继发细菌感染。早期骨细胞消失，骨陷窝空虚，并可见微裂。后期死骨形成。掌握“结核性骨髓炎及放射性骨髓炎”知识点。